治疗胃癌痰湿阻胃证，应首选
A. 四君子汤
B. 理中汤
C. 玉女煎
D. 八珍汤
E. 开郁二陈汤

正确答案：E。开郁二陈汤

解析：胃癌痰湿阻胃证的机理为脾虚失运，痰湿内生，痰湿滞胃，胃失和降，故见脘膈痞闷，胃气上逆则呕吐痰涎，进食发噎不顺，故其治法为燥湿健脾、消痰和胃，方药首选化痰燥湿和胃的开郁二陈汤加减（E对）。四君子汤（A错）合理中汤（B错）加陈皮、半夏可以温中散寒，健脾益气，多用于治疗胃癌脾胃虚寒证；玉女煎（C错）可清热和胃，养阴润燥，多用于治疗胃癌胃热伤阴证；八珍汤（D错）可益气养血，健脾和营，多用于治疗胃癌气血两虚证。